大黄粉末的甲醇温浸液点于滤纸上，以45%的乙醇展开，晾干。置紫外光灯（365nm）下检视，不得显持久的亮紫色荧光，此实验检查的成分是
A. 土大黄苷
B. 大黄酸
C. 番泻苷
D. 大黄素
E. 芦荟大黄素

正确答案：A。土大黄苷

解析：本题考查大黄的检识。置紫外光灯（365nm）下检视，不得显持久的亮紫色荧光，此实验检查的成分是土大黄苷（A对）。土大黄苷取本品粉末0.1g，加甲醇10mL，超声20分钟，滤过，取滤液1mL，加甲醇至10mL，作为供试品溶液。另取土大黄苷对照品，加甲醇制成每1mL含10㎍溶液，作为对照品溶液（临用新制）。吸取上述两种溶液各5μL，分别点于同一聚酰胺薄膜上，以甲苯-甲酸乙酯-丙酮-甲醇-甲酸（30：5：5：20：0.1）为展开剂，展开，取出，晾干，置紫外光灯（365nm）下检视。供试品色谱中，在与对照品色谱相应的位置上，不得显相同的亮蓝色荧光斑点。大黄【含量测定】按《中国药典》采用高效液相色谱法测定，本品含总蒽醌以芦荟大黄素（E错）、大黄酸（B错）、大黄素（D错）、大黄酚和大黄素甲醚的总量不得少于1.50%；含游离蒽醌以芦荟大黄素、大黄酸、大黄素、大黄酚和大黄素甲醚总量不得少于0.20%；饮片含游离蒽醌不少于0.35%。番泻叶【成分】狭叶番泻叶含番泻苷（C错）A及B（A、B.两者互为立体异构）、番泻苷C及D（C、D,两者互为立体异构）、芦荟大黄素双蒽酮苷、大黄酸葡萄糖苷、芦荟大黄素葡萄糖苷及少量大黄酸、芦荟大黄素。此外，尚含山柰素、番泻叶山奈苷、蜂花醇、水杨酸、棕桐酸、硬脂酸、植物甾醇及其苷等。